肝胃蕴热的口味是
A. 口中泛酸
B. 口中酸馊
C. 口甜黏腻
D. 口中味苦
E. 口中味咸

正确答案：A。口中泛酸

解析：若患者口中泛吐酸水（A对），嗳气不适，脘腹疼痛者，多因肝火横逆犯胃，木郁作酸，故见泛吐酸水。若患者口中有酸馊味（B错），口气酸臭者，多因暴饮暴食，损伤胃肠，食积不化，胃中浊气上泛所致。口甜，多与脾胃病有关。若口中甜而胶黏（C错），为脾胃湿热。因湿热内阻，脾胃升降失职，浊气上蒸，故见口甜黏腻。口苦（D错），见于实热证，尤以心、肝、胆火旺者多见。口咸（E错），见于肾虚或寒证。因咸入肾，肾阴不足，虚火上炎；又或肾阳亏虚，寒水上泛，皆可令口中有咸味。